以下有关黏附分子描述错误的是
A. 黏附分子是一类介导细胞间或细胞与细胞外基质间相互黏附和结合的跨膜糖蛋白
B. 黏附分子按其结构特点可分为整合素、选择素、黏蛋白样血管地址素、免疫球蛋白超家族等4个家族或4类
C. 黏附分子间可相互作用，且作用可逆
D. 黏附分子可协助免疫细胞识别
E. 黏附分子可介导淋巴细胞归巢

正确答案：B。黏附分子按其结构特点可分为整合素、选择素、黏蛋白样血管地址素、免疫球蛋白超家族等4个家族或4类